当阑尾血运障碍时，易导致其坏死的解剖学特点是
A. 阑尾淋巴组织丰富
B. 阑尾体积小
C. 阑尾动脉为无侧支终末动脉
D. 阑尾腔小
E. 阑尾开口小

正确答案：C。阑尾动脉为无侧支终末动脉

解析：阑尾动脉是回结肠动脉的分支，是一种无侧支的终末动脉，这一解剖学特点使阑尾发生血运障碍时，易导致其缺血坏死（C对）。阑尾丰富的淋巴组织增生（A错）、阑尾体积小（B错）、阑尾腔小（D错）、阑尾开口小（E错）等为阑尾管腔容易发生堵塞的解剖学基础，而阑尾腔堵塞是急性阑尾炎的最常见原因。